粘接固定桥的固位主要是依靠
A. 摩擦力
B. 轴沟
C. 金属翼板环抱作用
D. 粘接材料的粘结力
E. 粘结和卡环

正确答案：D。粘接材料的粘结力

解析：本题考查固定桥的设计。粘接固定桥：是利用酸蚀、粘结技术将固定桥直接粘固于基牙上，修复牙列缺损，其固位主要依靠粘结材料的粘结力（D对），而牙体制备的固位形为辅助固位作用。